抑制血管紧张素转化酶而治疗高血压是
A. 硝苯地平
B. 卡托普利
C. 氯沙坦
D. 可乐定
E. 米诺地尔

正确答案：B。卡托普利

解析：本题考查卡托普利。卡托普利（B对）是血管紧张素转换酶抑制剂，抑制血管紧张素Ⅰ转化为血管紧张素Ⅱ，同时还作用于缓激肽系统，抑制缓激肽降解，从而扩张血管、降低血压，发挥治疗高血压的作用。硝苯地平（A错）是钙通道阻滞剂。氯沙坦（C错）是血管紧张素Ⅱ受体阻断剂。可乐定（D错）为中枢α₂受体激动剂。米诺地尔（E错）是钾离子通道激动剂。